升主动脉的分支
A. 头臂干
B. 食管动脉
C. 支气管动脉
D. 肋间后动脉
E. 冠状动脉

正确答案：E。冠状动脉

解析：冠状动脉（E对）为升主动脉的分支，升主动脉发出左、右冠状动脉。